下列静脉哪条不是下腔静脉的直接属支
A. 肝门静脉
B. 肝静脉
C. 左肾静脉
D. 左腰静脉
E. 右睾丸静脉

正确答案：A。肝门静脉

解析：肝门静脉（A错，为本题正确答案）直接注入肝血窦，再经肝静脉注入下腔静脉。肝静脉（B对）、左肾静脉（C对）、左腰静脉（D对）、右睾丸静脉（E对）均为下腔静脉的直接属支。